肺结核的主要传播途径是
A. 空气传播
B. 消化道传播
C. 血液传播
D. 垂直传播
E. 虫媒传播

正确答案：A。空气传播